气香浓烈，味甜辣的饮片是
A. 黄柏
B. 牡丹皮
C. 秦皮
D. 香加皮
E. 肉桂

正确答案：E。肉桂

解析：本题考查的是肉桂的性状鉴别。气香浓烈，味甜辣的饮片是肉桂（E对）。肉桂：【性状鉴别】药材呈槽状或卷筒状。外表面灰棕色，稍粗糙，有不规则的细皱纹及横向突起的皮孔，有的可见灰白色的斑纹；内表面红棕色，较平坦，有细纵纹，划之显油痕。质硬而脆，易折断，断面不平坦，外层棕色而较粗糙，内层红棕色而油润，两层中间有1条黄棕色的线纹。气香浓烈，味甜、辣。黄柏（A错）：【性状鉴别】饮片呈丝条状，外表黄褐色或黄棕色，内表面暗黄色或淡棕色，具纵棱纹。切面纤维性，呈裂片状分层，深黄色。味极苦。牡丹皮（B错）：【性状鉴别】饮片呈圆形或卷曲形的薄片。连丹皮外表面灰褐色或黄褐色，栓皮脱落处粉红色；刮丹皮表面红棕色或淡灰黄色。内表面有时可见发亮的结晶，切面淡粉红色，粉性。气芳香，味微苦而涩。秦皮（C错）：【性状鉴别】饮片呈长短不一的丝条状。外表面灰白色、灰棕色或黑棕色。内表面黄白色或棕色，平滑。切面纤维性。质硬。气微，味苦。香加皮（D错）：【性状鉴别】饮片呈不规则的厚片。外表面灰棕色或黄棕色，栓皮常呈鳞片状。内表面淡黄色或淡黄棕色，有细纵纹。切断面黄白色。有特异香气，味苦。